噬菌体是侵袭微生物的
A. 细菌
B. 病毒
C. 原虫
D. 支原体
E. 真菌

正确答案：B。病毒

解析：噬菌体是感染细菌、真菌、放线菌或螺旋体等微生物的病毒。噬菌体具有病毒的基本特性。分布极广，有严格的宿主特性（只寄生在易感宿主菌体内并裂解细菌）。掌握“噬菌体性状及分类”知识点。